伯氨喹的作用机制是
A. 主要用于防止疟疾复发和传播
B. 为病因性预防抗疟药
C. 抑制蚊体内疟原虫的有性生殖
D. 作用于继发性红细胞外期疟原虫及人体血液中各型疟原虫配子体
E. 对葡萄糖-6磷酸脱氢酶缺乏者可致急性溶血性贫血或高铁血红蛋白血症

正确答案：A、D、E。主要用于防止疟疾复发和传播；作用于继发性红细胞外期疟原虫及人体血液中各型疟原虫配子体；对葡萄糖-6磷酸脱氢酶缺乏者可致急性溶血性贫血或高铁血红蛋白血症

解析：本题考查伯氨喹的作用机制。伯氨喹为抗疟疾药，对红细胞外期及各型疟原虫的配子体均有较强的杀灭作用（D对），对红细胞内期作用较弱，对恶性疟红细胞内期无效，因此不能控制疟疾症状的发作。临床可作为控制复发和阻止疟疾传播的首选药（A对）。伯氨喹禁用于葡萄糖-6-磷酸脱氢酶缺乏者，葡萄糖-6-磷酸脱氢酶缺乏者服用伯氨喹可发生急性溶血性贫血（E对），这种溶血反应仅限于衰老的红细胞。乙胺嘧啶主要是用于病因性预防的药物（B错），用于抑制疟原虫的二氢叶酸还原酶，影响疟原虫叶酸代谢过程。疟原虫在在人体为无性生殖，在蚊体内为有性生殖，伯氨喹不用于抑制蚊体内疟原虫的有性生殖（C错）。